男，44岁。患尿毒症急需肾移植。患者希望亲属捐肾，经查患者姐姐待业的儿子组织配型合适，并愿意捐献一侧肾脏，患者则承诺术后办理病退并设法让其接替工作。了解该情况后，医院器官移植伦理审查委员会没有批准此捐献。伦理审查委员会所依据的伦理原则是
A. 双方自主原则
B. 患者健康利益至上原则
C. 无偿与禁止商业化原则
D. 尊重和保护供者原则
E. 知情同意原则

正确答案：C。无偿与禁止商业化原则

解析：我国人体器官移植的伦理原则：（－）患者利益至上原则（B错），（二）自愿（A错）、无偿、禁止买卖原则（C对），（三）知情同意原则（E错），（四）尊重和保护供体原则（D错），（五）保密原则，（六）公平、公正、公开原则。患者承诺术后办理病退并设法让捐献者接替工作，违背了无偿与禁止商业化原则（C对）。